烧伤后第一个8小时应输入的液体量为估计伤后第1个24小时补液总量的
A. 2/3
B. 1/3
C. 1/2
D. 1/4
E. 1/5

正确答案：C。1/2

解析：补液是防治烧伤休克最重要的措施。常根据病人的烧伤面积和体重计算。伤后第1个24小时补液量为成人每1%Ⅱ°、Ⅲ°烧伤面积每公斤体重补充胶体液0.5ml和电解质液1ml，伤后前8小时内输入一半（即1/2）（C对）。